以下哪种疫苗不是采用注射法接种
A. 麻疹活疫苗
B. 乙肝疫苗
C. 脊髓灰质炎三价混合疫苗
D. 卡介苗
E. 百白破混合疫苗

正确答案：C。脊髓灰质炎三价混合疫苗

解析：本题考查各类疫苗的接种方式。脊髓灰质炎三价混合疫苗（C对）口服接种，糖丸剂型每次1粒。麻疹活疫苗（A错）上臂外侧三角肌下缘，皮下注射0.5ml。乙肝疫苗（B错）上臂外侧三角肌或大腿前外侧中部，肌内注射。卡介苗（D错）上臂外侧三角肌中部略下处，皮内注射0.1ml。百白破混合制剂（E错）上臂外侧三角肌或臀部，肌内注射0.5ml